患者，女，45岁。因急腹症入院，诊断为化脓性胆囊炎穿孔并发绿脓杆菌性腹膜炎，既往有青霉素过敏史。抗感染治疗应选用
A. 羟苄青霉素
B. 头孢氨苄
C. 红霉素
D. 氯林可霉素
E. 环丙沙星

正确答案：E。环丙沙星

解析：患者胆囊炎穿孔、并发绿脓杆菌感染，因此选用抗菌药，患者有青霉素过敏史，应避免使用青霉素类，选择喹诺酮类等。环丙沙星抗菌谱较广，对需氧革兰阴性杆菌抗菌活性强，对铜绿假单胞菌等的抗菌活性高于其他同类药物用于治疗敏感菌引起的泌尿生殖道、胃肠道、软组织等部位的感染（E对）。